6岁的娟娟今年9月入学成了一名小学生。上学的第1周，她总是在课堂上低头玩弄小手绢，老师便不断提醒她，“娟娟，抬头看黑板”。第2周娟娟就能认真听讲了。可是到了学期末，她时常在课堂上做小动作，学习效率降低。娟娟在学期末学习效率减低是
A. 年龄小的缘故
B. 厌倦学习的表现
C. 淘气的表现
D. 对学习内容没兴趣的原因
E. 脑力工作能力的变化规律

正确答案：E。脑力工作能力的变化规律